嵌顿疝与绞窄疝的鉴别要点是
A. 深（内）环口的大小
B. 有无休克
C. 不能还纳的时间
D. 有无肠梗阻
E. 有无血循环障碍

正确答案：E。有无血循环障碍

解析：绞窄性疝由嵌顿性疝转化而来，前者实际上是后者病理过程的延伸。嵌顿疝无动脉血运障碍，绞窄性疝有血运障碍，因此嵌顿疝与绞窄疝的鉴别要点是有无血循环障碍（E对）。深（内）环口的大小与是否发生嵌顿有关；休克可见于绞窄疝晚期患者；疝块不能回纳的时间越长，发生绞窄疝的几率越高，但深（内）环口的大小（A错）、有无休克（B错）、不能还纳的时间（C错）均不能作为嵌顿疝和绞窄疝的鉴别要点。疝内容物为肠袢时，嵌顿疝和绞窄疝均可出现肠梗阻，因此，有无肠梗阻（E错）不能作为二者的鉴别要点。